2000年我国开展了一次全国结核病流行病学调查。该调查将全国各地区划分为东、中、西和京津沪地区，并按有无结核病控制专项项目分为项目地区和非项目地区，在上述各地区中按1：3125的比例，随机抽取257个调查点，每个点的人数约为1500人。调查发现，我国的活动性肺结核、涂阳（痰涂片阳性）肺结核和菌阳（痰培养）肺结核患病率分别为367/10万，122/10万和160/10万，且农村高于城市，中西部地区高于东南沿海，非项目地区高于项目地区。该研究没有使用
A. 随机抽样
B. 分层抽样
C. 整群抽样
D. 比例抽样
E. 非概率抽样

正确答案：E。非概率抽样